访谈法收集资料的方式
A. 面询和电话询问
B. 电话询问
C. 面询
D. 入户调查
E. 抽样调查

正确答案：A。面询和电话询问